与免疫复合物型超敏反应有关的疾病是
A. 新生儿溶血症
B. 链球菌感染后肾小球肾炎
C. 肺出血-肾炎综合征
D. 血细胞减少症
E. Graves病

正确答案：B。链球菌感染后肾小球肾炎